上述哪种急性期蛋白可抑制蛋白酶？
A. C-反应蛋白
B. 纤维连接蛋白
C. 白蛋白
D. 血浆铜蓝蛋白
E. α1-抗糜蛋白酶

正确答案：E。α1-抗糜蛋白酶

解析：α1-抗糜蛋白酶（E对）可抑制蛋白酶。